药物以液滴状态分散在分散介质中所构成的体系属于
A. 溶液型
B. 胶体溶液型
C. 乳浊型
D. 混悬型
E. 固体分散型

正确答案：C。乳浊型

解析：本题考查药物剂型的分类。药物以液滴状态分散在分散介质中所构成的体系属于乳浊型（C对）。乳浊型是油类药物或药物油溶液以液滴状分散于分散介质中所形成的非均匀分散体系。溶液型（A错）体系中药物以分子或离子状态存在。胶体溶液型（B错）主要是以高分子分散于分散介质中所形成的均匀分散体系。混悬型（D错）体系中固体药物以微粒状态存在。固体分散型（E错）体系中固体药物以聚集状态存在。